分子中含有膦酰基的血管紧张素转换酶抑制药是
A. 福辛普利
B. 依那普利
C. 赖诺普利
D. 喹那普利
E. 卡托普利

正确答案：A。福辛普利

解析：本题考查福辛普利。福辛普利（A对）是分子中含有膦酰基的血管紧张素转换酶抑制药。依那普利（B错）是双羧基的血管紧张素转换酶抑制药的代表。赖诺普利（C错）是分子中含有游离双羧酸的血管紧张素转换酶抑制药。喹那普利（D错）是依那普利的结构中的脯氨酸被四氢异喹啉羧酸所替代的药物。卡托普利（E错）是分子中含有巯基的抗高血压药，对血管紧张素转换酶产生较强抑制作用。